某地为了了解5-56岁肝吸虫感染情况，予行大便常规检查，这种行为属于
A. 筛检
B. 研究
C. 抽查
D. 调查
E. 确诊

正确答案：A。筛检

解析：筛检也称筛查，是针对临床前期或早期的疾病阶段，运用快速、简便的试验、检查或其他方法，将未诊断或未察觉疾病的人群中那些可疑有病或有缺陷的、但表面健康的个体，同可能无病者鉴别开来的一系列医疗卫生服务措施（A对）。